最常见的颞下颌关节紊乱病是
A. 双板区撕裂
B. 关节囊扩张
C. 髁突囊样变
D. 关节盘前附着断裂
E. 关节盘前移位

正确答案：E。关节盘前移位

解析：本题考查颞下颌关节紊乱病。最常见的颞下颌关节紊乱病是关节盘前移位（E对）。颞下颌关节紊乱病临床常见的类型为可复性盘前移位及不可复性盘前移位。髁突囊样变（C错）属于颞下颌关节骨关节病。